某女，53岁。症见四肢厥逆、恶寒踡卧、呕吐不渴、腹痛下利、神衰欲寐，舌苔白滑，脉象微细。医师处以四逆汤。处方组成：淡附片300g、干姜200g、炙甘草300g。制法：以上三味，淡附片、炙甘草加水煎煮二次，第一次2小时，第二次1.5小时，合并煎液，滤过。干姜用水蒸气蒸馏提取挥发油，挥发油和蒸馏后的水溶液备用；姜渣再加水煎煮1小时，煎液与上述水溶液合并，滤过，再与淡附片、炙甘草的煎液合并，浓缩至约400ml，放冷，加乙醇1200ml，搅匀，静置24小时，滤过，减压浓缩至适量，用适量水稀释，冷藏24小时，滤过，加单糖浆、苯甲酸钠与上述挥发油，加水至1000ml，搅匀，灌封，灭菌，即得。其质量应符合《中国药典》合剂项下有关的各项规定。该方炙甘草和制剂的质量控制成分为甘草酸其结构类型是
A. 甾体皂苷
B. 强心苷
C. 胆汁酸类
D. 蜕皮激素
E. 三萜皂苷

正确答案：E。三萜皂苷

解析：本题考查的是甘草的化学成分。四逆汤中炙甘草和制剂的质量控制成分为甘草酸其结构类型是三萜皂苷（E对）。甘草所含的三萜皂苷以甘草皂苷含量最高。甘草皂苷又称甘草酸，为甘草中的甜味成分。甾体皂苷（A错）与三萜皂苷相似，均由甾体皂苷元与糖组成，这是天然广泛存在的一类化学成分。甾体皂苷分类主要有螺旋甾烷醇类、异螺旋甾烷醇类、呋甾烷醇类和变形螺旋甾烷醇类等。香加皮中含有的强心苷（B错）类化合物为甲型强心苷，其中杠柳毒苷和杠柳次苷为其主要成分。熊胆的化学成分为胆汁酸类（C错）的碱金属盐及胆甾醇和胆红素。牛膝含有甾体化合物，包括蜕皮激素（D错）和植物甾醇等，蜕皮激素主要为羟基促蜕皮甾酮和牛膝甾酮。